任何单位或者个人开展诊疗活动，必须依法取得
A. 《设置医疗机构批准书》
B. 《设置医疗机构备案回执》
C. 《医疗机构执业许可证》
D. 《医疗机构校验申请书》
E. 《医疗机构申请变更登记注册书》

正确答案：C。《医疗机构执业许可证》

解析：《医疗机构管理条例》规定，只有依法取得设置医疗机构批准书，并履行登记手续，领取了《医疗机构执业许可证》的单位或者个人才能开展相应的诊断、治疗活动。因此任何单位或者个人开展诊疗活动，必须依法取得《医疗机构执业许可证》（C对）。